某男，45岁，时发胃脘胀痛，窜及两肋，得嗳气或矢气则舒，情绪郁怒则加重，伴胸闷食少，排便不畅，苔薄白，脉弦，医师诊为气滞型胃脘痛，宜选用的成药是
A. 左金丸
B. 四逆散
C. 越鞠丸
D. 胃苏颗粒
E. 木香顺气丸

正确答案：D。胃苏颗粒

解析：本题考查的是胃苏颗粒的主治。时发胃脘胀痛，窜及两肋，得嗳气或矢气则舒，情绪郁怒则加重，伴胸闷食少，排便不畅，苔薄白，脉弦，医师诊为气滞型胃脘痛，宜选用的成药是胃苏颗粒（D对）。胃苏颗粒：【主治】气滞型胃脘痛，症见胃脘胀痛、窜及两胁、得嗳气或矢气则舒、情绪郁怒则加重、胸闷食少、排便不畅、舌苔薄白、脉弦；慢性胃炎及消化性溃疡见上述证候者。左金丸（A错）：【主治】肝火犯胃，脘胁疼痛，口苦嘈杂，呕吐酸水，不喜热饮。四逆散（B错）：【主治】肝气郁结、肝脾不和所致的胁痛、痢疾，症见脘腹胁痛、热厥手足不温、泻痢下重。越鞠丸（C错）：【主治】瘀热痰湿内生所致的脾胃气郁，症见胸脘痞闷、腹中胀满、饮食停滞、嗳气吞酸。木香顺气丸（E错）：【主治】湿阻中焦、脾胃不和所致的湿滞脾胃证，症见胸膈痞闷、脘腹胀痛、呕吐恶心、嗳气纳呆。